男，50岁。口腔内起白斑。检查：口腔内左侧黏膜及腭上灰白色光滑而微隆起的斑块，双侧前臂散在性玫瑰红色斑疹。低烧，头痛。患者自述阴茎部曾有过溃疡，已痊愈。该病初步印象是梅毒，进一步确诊需检测的项目是
A. 快速血凝反应（RPR）
B. Tzack细胞检查
C. 类风湿因子
D. 结核菌素试验
E. HIV抗体检测

正确答案：A。快速血凝反应（RPR）

解析：本题考查梅毒的辅助检查。快速血凝反应（RPR）（A对）检测患者血清非螺旋体特异性抗体，敏感性高，操作简便，经济快速，用于病例筛查，常用作梅毒的初步诊断方法。Tzack细胞检查（B错）用于检查天疱疮。类风湿因子（C错）是检验类风湿关节炎的生化检查。结核菌素试验（D错）是检验结核的试验。HIV抗体检测（E错）用于检测HIV。